机体在接受抗原刺激以后，产生的针对抗原的特异性免疫应答，称为
A. 固有性免疫应答
B. 适应性免疫应答
C. 免疫耐受
D. 超敏反应
E. 自身免疫

正确答案：B。适应性免疫应答

解析：适应性免疫应答是机体在接受抗原刺激后产生的针对抗原的特异性免疫应答，即T、B淋巴细胞经TCR、BCR识别结合抗原表位后发生的特异性免疫应答。掌握“免疫应答基本概念、固有及适应性免疫应答”知识点。